下列不属于人际暴力主要表现形式的是
A. 亲密关系暴力
B. 帮派暴力
C. 冷暴力
D. 虐待老人
E. 青少年暴力

正确答案：C。冷暴力

解析：本题考查人际暴力的表现形式。人际暴力的主要表现形式包括：①儿童虐待；②青少年暴力（E对）；③亲密关系暴力（A对）；④性暴力；⑤虐待老人（D对）；⑥工作场所暴力；⑦针对性暴力；⑧帮派暴力（B对）。冷暴力（C错，为本题正确答案）不属于人际暴力的主要表现形式。